全身麻醉时，为迅速进入外科麻醉期可选用
A. 硫喷妥钠
B. 阿托品
C. 吗啡
D. 异氟烷
E. 恩氟烷

正确答案：A。硫喷妥钠

解析：本题考查巴比妥类药物。全身麻醉时，为迅速进入外科麻醉期可选用硫喷妥钠（A对）。硫喷妥钠脂溶性高，静脉注射后几秒钟即可进入脑组织，使患者迅速进入外科麻醉期；阿托品（B错）为阻断M胆碱受体的抗胆碱药；吗啡（C错）为镇痛药，不用于外科手术的麻醉；异氟烷（D错）为吸入麻醉剂；恩氟烷（E错）为吸入性全麻药，用于复合全身麻醉。